关于医疗器械产品注册与备案管理的说法，错误的是
A. 港澳台地区医疗器械注册，参照进口医疗器械办理
B. 第二类医疗器械实行注册管理
C. 第一类医疗器械实行注册管理
D. 算三类医疗器城实行注册管理

正确答案：C。第一类医疗器械实行注册管理

解析：本题考查医疗器械的产品注册与备案管理。第一类医疗器械实行产品备案管理（C错，为本题正确答案）。医疗器械的产品注册与备案管理：第一类医疗器械实行产品备案管理。第二类、第三类医疗器械实行产品注册管理（BD对）。医疗器械注册人、备案人应当加强医疗器械全生命周期质量管理，对研制、生产、经营、使用全过程中医疗器械的安全性、有效性依法承担责任。第一类医疗器械备案，由备案人向所在地设区的市级人民政府负责药品监督管理的部门提交备案资料。境内第二类医疗器械由注册申请人所在地省、自治区、直辖市人民政府药品监督管理部门审查，批准后发给医疗器械注册证。境内第三类医疗器械由国务院药品监督管理部门审查，批准后发给医疗器械注册证。进口医疗器械，应当由境外生产企业作为注册申请人或者备案人，由其在我国境内设立的代表机构或者指定我国境内的企业法人作为代理人，申请注册或者办理备案。进口第一类医疗器械备案，境外备案人由其指定的我国境内企业法人向国务院药品监督管理部门提交备案资料和备案人所在国（地区）主管部门准许该医疗器械上市销售的证明文件。进口第二类、第三类医疗器械由国务院药品监督管理部门审查，批准后发给医疗器械注册证。香港、澳门、台湾地区医疗器械的注册、备案，参照进口医疗器械办理（A对）。